下列各项不支持艾滋病诊断的是
A. 口咽念珠菌感染
B. 持续发热
C. 头痛，进行性痴呆
D. 皮肤黏膜出血
E. 慢性腹泻

正确答案：D。皮肤黏膜出血

解析：艾滋病艾滋病期的诊断依据：有流行病学史，HIV抗体阳性，加下列诊断条件中的任何一项；或HIV抗体阳性，CD4⁺T淋巴细胞数<200∕mm3：①原因不明的38℃以上持续不规则发热（B对），>1个月。②慢性腹泻（E对）次数多于每日3次，>1个月。③6个月之内体重下降10%以上。④反复发作的口腔白色念珠菌感染（A对）。⑤反复发作的单纯疱疹病毒感染或带状疱疹病毒感染。⑥肺孢子菌肺炎。⑦反复发生的细菌性肺炎。⑧活动性结核或非结核分枝杆菌病。⑨深部真菌感染。⑩中枢神经系统占位性病变，头痛。⑪中青年人出现进行性痴呆（C对）。⑫活动性巨细胞病毒感染。⑬弓形虫病。⑭青霉菌感染。⑮反复发生的败血症。⑯卡波西肉瘤。⑰淋巴瘤。皮肤黏膜出血（D错，为本题正确答案）可由多种原因造成，不支持艾滋病的诊断。